因药物组成中含朱砂，不宜过量服用或久服的成药有
A. 紫金锭
B. 琥珀抱龙丸
C. 牛黄抱龙丸
D. 龙牡壮骨颗粒
E. 柏子养心丸

正确答案：A、B、C、E。紫金锭；琥珀抱龙丸；牛黄抱龙丸；柏子养心丸

解析：本题考查的是紫金锭、琥珀抱龙丸、牛黄抱龙丸、柏子养心丸的注意事项。因药物组成中含朱砂，不宜过量服用或久服的成药有紫金锭（A对）、琥珀抱龙丸（B对）、牛黄抱龙丸（C对）、柏子养心丸（E对）。紫金锭：【注意事项】因其含雄黄、朱砂等峻烈有毒之品，故不宜过量使用、久用，孕妇忌用，气血虚弱及肝肾功能不全者慎用。琥珀抱龙丸：【注意事项】慢惊风，以及久病、气虚者忌服。寒痰停饮咳嗽、脾胃虚弱、阴虚火旺者慎用。外伤瘀血痫疾不宜单用本品。因其含朱砂，故不宜过量服用或久用。服药期间，饮食宜清淡，忌食辛辣刺激、油腻食物。小儿高热惊厥抽搐不止者，应及时送医院抢救。牛黄抱龙丸：【注意事项】慢惊风或阴虚火旺所致的虚风内动者慎用。因其含朱砂、雄黄，故不宜过量服用或久用。服药期间，饮食宜清淡，忌食辛辣、油腻食物。小儿高热惊厥抽搐不止，应及时送医院抢救。柏子养心丸：【注意事项】肝肾功能不全者禁用。肝阳上亢及阴虚内热者不宜服。服药期间，应保持精神舒畅，劳逸适度，不宜饮用浓茶、咖啡等兴奋性饮品。因其含朱砂，故不可过量服用、久用，不可与溴化物、碘化物同服。龙牡壮骨颗粒（D错）：【注意事项】实热证者慎用。服药期间忌食辛辣、油腻食物。患儿发热期间暂停服本品，佝偻病合并手足搐搦者应配合其他治疗。